属于膨胀性泻药的是
A. 硫酸镁
B. 聚乙二醇4000
C. 乳果糖
D. 蓖麻油
E. 甘油

正确答案：B。聚乙二醇4000

解析：本题考查泻药的分类。聚乙二醇4000（B对）属于膨胀性泻药，在肠内吸收水分后膨胀形成胶体，使肠内容物变软，体积增大，反射性增加肠蠕动而刺激排便。硫酸镁（A错）为容积性泻药。乳果糖（C错）为渗透性泻药。蓖麻油（D错）为刺激性泻药。甘油（E错）为润滑性泻药。